若设计为支架式可摘局部义齿，初戴时腭杆与黏膜的最适合关系是
A. 轻轻接触
B. 紧密接触
C. 离开0.5mm
D. 离开1.5mm
E. 不能无压力

正确答案：A。轻轻接触

解析：本题考查腭杆与黏膜的关系。若设计为支架式可摘局部义齿，初戴时腭杆与黏膜的最适合关系是轻轻接触（A对）。支架式可摘局部义齿中的腭杆一般情况下要求与黏膜轻轻接触，如有间隙如腭杆与黏膜离开0.5mm（C错）、离开1.5mm（D错），唾液在杆与黏膜之间流动，容易刺激黏膜，使患者恶心，另外食物也容易滞积。而紧密接触（B错）和不能无压力（E错）均会造成黏膜压力。